下列哪种情况体温升高属于发热？
A. 甲状腺功能亢进
B. 急性肺炎
C. 环境高温
D. 妇女月经前期
E. 先天性汗腺缺乏

正确答案：B。急性肺炎

解析：临床上见到的体温升高，可分为调节性体温升高（发热）和非调节性体温升高（过热）。甲状腺功能亢进（A错）、环境高温（C错）和先天性汗腺缺乏（E错）属于过热；先天性汗腺缺乏（E错）属于生理性反应。急性肺炎（B对）是由于致热原引起的发热。